桔梗的特征为
A. 药材断面白色，粉性
B. 药材横断面可见黄色小孔呈放射状排列
C. 二者均是
D. 二者均非

正确答案：D。二者均非

解析：本题考查的是桔梗药材的性状鉴别。桔梗质脆，断面不平坦，横切面可见放射状裂隙，皮部黄白色，形成层环棕色，木部淡黄色（D对）。桔梗：【性状鉴别】药材呈圆柱形或略呈纺锤形，下部渐细，有的有分支，略扭曲。表面淡黄色至黄色，不去外皮的表面黄棕色至灰棕色，具纵扭皱沟，并有横长的皮孔样斑痕及支根痕，上部有横纹。有的顶端有较短的根茎或不明显，其上有数个半月形茎痕。质脆，断面不平坦，横切面可见放射状裂隙，皮部黄白色，形成层环棕色，木部淡黄色。气微，味微甜后苦。药材断面白色，粉性（A错）与药材横断面可见黄色小孔呈放射状排列（B错）为天花粉药材的鉴别特征。天花粉：【性状鉴别】药材呈不规则圆柱形、纺锤形或瓣块状。表面黄白色或淡棕黄色，有纵皱纹、细根痕及略凹陷的横长的皮孔；有的有黄棕色外皮残留。质坚实，断面白色或淡黄白色，富粉性，横切面可见黄色小孔（导管），略呈放射状排列，纵切面可见黄色条纹状木质部。气微，味微苦。